新生儿丹毒又称为
A. 赤游丹
B. 抱头火丹
C. 流火
D. 内发丹毒
E. 腿游风

正确答案：A。赤游丹

解析：丹毒是患部皮肤突然发红成片、色如涂丹的急性感染性疾病。本病发无定处，根据其发病部位的不同又有不同的病名。如生于躯干部者，称内发丹毒（D错）；发于头面部者，称抱头火丹（B错）；发于小腿足部者，称流火（C错）；发于腿胫部者，称腿游风（E错）新生儿多生于臀部，称赤游丹毒（A对）。